反射时间的长短主要取决于
A. 刺激的性质
B. 刺激的强度
C. 感受器的敏感度
D. 神经的传导速度
E. 反射中枢突触的多少

正确答案：E。反射中枢突触的多少